病损可分为疱型与苔藓型，疱型是上皮与结缔组织间形成基底下疱，苔藓型上皮萎缩，基底细胞水肿，见胶样小体，为以上哪项病理特征
A. 牙周萎缩
B. 牙周炎
C. 增生性龈炎
D. 慢性龈炎
E. 剥脱性龈病损

正确答案：E。剥脱性龈病损

解析：本题考查牙龈疾病。病损可分为疱型与苔藓型，疱型是上皮与结缔组织间形成基底下疱，苔藓型上皮萎缩，基底细胞水肿，见胶样小体，为剥脱性龈病损（E对）。剥脱性龈病损可分为疱型与苔藓型。疱型是上皮与结缔组织间形成基底下疱，苔藓型者，上皮萎缩，基底细胞水肿，基底层附近常见胶样小体，病变符合于疱型或萎缩型扁平苔藓。